女性，66岁。主诉：排便时阴道脱出一块状物。检查时用力时阴道前壁脱出，宫颈外口露于阴道口外。本例选择恰当的手术为
A. Manchester手术
B. 阴道前后壁修补术
C. 阴式子宫全切术
D. 阴式子宫全切术+阴道前壁修补术
E. 经腹子宫全切术

正确答案：D。阴式子宫全切术+阴道前壁修补术

解析：Manchester手术（A错）适用于年龄较轻、宫颈延长的子宫脱垂患者，由于患者66岁，年龄较大，因此Manchester手术不恰当。阴道前后壁修补术（B错）为阴道前后壁膨出的手术治疗方法，但不能根治子宫脱垂，因此阴道前后壁修补术不符合。阴式子宫全切术（C错）能治疗宫颈外口露于阴道口，但不能防止阴道前壁脱出，因此阴式子宫全切术不符合。经腹子宫全切术（E错）虽然能治疗宫颈外口露于阴道口，但由于创伤大，并且不能防止阴道前壁脱出，因此经腹子宫全切术不符合。阴式子宫全切术+阴道前壁修补术（D对），适用于年龄较大、无需考虑生育功能的患者，既能治疗宫颈外口露于阴道口，又能防止阴道前壁脱出，因此阴式子宫全切术+阴道前壁修补术是最恰当的手术治疗方法。